小便浑浊如米泔为特征的证候是
A. 脾不统血证
B. 脾虚气陷证
C. 寒湿困脾证
D. 脾阳虚证
E. 脾气虚证

正确答案：B。脾虚气陷证

解析：脾气虚衰，升举无力，气坠于下，故脘腹重坠作胀，食后更甚；脾主散精，精微不能正常输布，反注膀胱，故小便混浊如米泔；脾气虚弱，化源亏乏，脏腑功能减退，故见气短懒言，神疲乏力（B对）。脾不统血证以各种慢性出血与气血亏虚症状为主要表现无下陷症状（A错）。寒湿困脾证以纳呆、腹胀、便溏、身重与寒湿症状为主要表现（C错）。脾阳虚证以食少、腹胀腹痛、便溏与虚寒症状为主要临床表现（D错）。脾气虚证以食少、腹胀、便溏与气虚症状为主要临床表现（E错）。